下列各项，可用来解释阴阳消长的是
A. 阳虚则寒
B. 阳长阴消
C. 寒者热之
D. 阴损及阳
E. 阴盛则阳病

正确答案：B。阳长阴消

解析：本题考查阴阳消长的临床表现，属于理解记忆内容。阴阳对立制约关系导致的阴阳消长变化主要表现为阴阳的互为消长，或表现为阴长阳消，或表现为阳长阴消（B对）。阳虚则寒、寒者热之、阴盛则阳病是阴阳之间的对立制约关系失调，动态平衡遭到了破坏的表现（ACE错）。阴损及阳是人体阴阳之间的互滋互用关系失常的表现（D错）。